以下哪一项不符合青少年的心理特点
A. 感情丰富
B. 认知功能全面和均衡发展
C. 像一个疾风怒涛的时期
D. 情绪体验敏感而稳定
E. 性观念已基本形成

正确答案：D。情绪体验敏感而稳定

解析：情绪体验敏感而不稳定。随着青少年接触大量的新生物，也伴随着大量的内心体验，使得他们的情绪和情感不断分化和成熟，但此时期的情绪特点是敏感而不稳定，反应快而强烈但不够持久。掌握“不同年龄阶段心理卫生”知识点。